可促进内质网释出Ca²⁺的是
A. cAMP
B. cGMP
C. IP₃
D. DG
E. PIP₂

正确答案：C。IP₃